对胰岛功能完全丧失的糖尿病患者仍有降血糖作用的药物是
A. 格列本脲
B. 二甲双胍
C. 甲苯磺丁脲
D. 氯磺丙脲
E. 格列吡嗪

正确答案：B。二甲双胍

解析：二甲双胍（B对）属于双胍类口服降糖药，降糖机制为减少葡萄糖在肠道的吸收，抑制糖原异生，减少肝葡萄糖的产生，促进组织对葡萄糖摄取和促进糖的无氧酵解而增加糖的利用，抑制胰高血糖素释放，因此对胰岛功能完全丧失的患者仍有降糖作用。格列本脲（A错）、甲苯磺丁脲（C错）、氯磺丙脲（D错）、格列吡嗪（E错）均属于磺酰脲类口服降糖药，此类药物对正常人和胰岛功能未完全丧失的糖尿病患者均有降血糖作用，可刺激胰岛B细胞释放胰岛素，所以对胰岛功能完全丧失的患者无效。